关于热原性质的说法，错误的是
A. 具有不挥发性
B. 具有耐热性
C. 具有氧化性
D. 具有水溶性
E. 具有滤过性

正确答案：C。具有氧化性

解析：本题考查热原的性质。热原能被强氧化剂如高锰酸钾、过氧化氢等破坏，因此不具有氧化性（C错，为本题正确答案）。热原的性质：（1）水溶性（D对）；（2）不挥发性（A对）；（3）耐热性（B对）；（4）过滤性（E对）；（5）其他性质。热原能被强酸、强碱、强氧化剂如高锰酸钾、过氧化氢以及超声波破坏。热原在水溶液中带有电荷，也可被某些离子交换树脂所吸附。